粉尘作业工人佩藏防尘面具的行为属于
A. 保健行为
B. 预警行为
C. 基本健康行为
D. 避免有害环境的行为
E. 利用卫生服务行为

正确答案：D。避免有害环境的行为